上颌骨骨化中心生长方向说法正确的是
A. 向后形成颧突
B. 向内形成腭突
C. 向下形成牙槽突
D. 向前形成上颌的表面组织
E. 以上说法均正确

正确答案：E。以上说法均正确

解析：上颌骨从这些骨化中心向以下几个方向生长：①向上形成上颌骨额突并支持眶部；②向后形成颧突；③向内形成腭突；④向下形成牙槽突；⑤向前形成上颌的表面组织。掌握“唾液腺与颌骨的发育”知识点。